体现叶天士“入血就恐耗血动血，直须凉血散血”的方剂是
A. 清营汤
B. 芍药汤
C. 白虎汤
D. 黄连解毒汤
E. 犀角地黄汤

正确答案：E。犀角地黄汤

解析：“入血就恐耗血动血，直须凉血散血”是指热入血分，极易迫血妄行而出血，煎灼血液而渐聚成瘀，故需要凉血止血，活血散瘀。犀角地黄汤中以苦咸寒之犀角为君，凉血清心而解热毒，使火平热降，毒解血宁。臣以甘苦寒之生地，凉血滋阴生津，一以助犀角清热凉血，并能止血；一以复已失之阴血。佐以苦微寒之赤芍与辛苦微寒之丹皮，清热凉血，活血散瘀，可收化斑之功。四药相配，共成清热解毒，凉血散瘀之剂（E对），以主治热入血分证。清营汤功用为清营解毒，透热养阴，主治热入营分证（A错）。芍药汤清热燥湿，调气和血，用于湿热痢疾（B错）。白虎汤主治气分热盛证（C错）。黄连解毒汤功用为泻火解毒，主治三焦火毒证（D错）。